70岁老年男性病人，左侧腹股沟突出半球形包块，不降入阴囊，咳嗽冲击试验阴性，易还纳，应诊断为
A. 鞘膜积液
B. 隐睾
C. 股疝
D. 斜疝
E. 直疝

正确答案：E。直疝

解析：老年（腹股沟直疝的多发人群）男性病人，左侧腹股沟突出半球形包块（提示腹股沟疝），不降入阴囊，咳嗽冲击试验阴性（腹股沟直疝的表现），应诊断为左侧腹股沟直疝（E对）。鞘膜积液（P581）（A错）指鞘膜囊内积聚的液体增多而形成囊肿，多表现为阴囊的囊性肿块，呈慢性、无痛性增大，可有阴囊下坠、胀痛和牵扯感，透光实验可为阳性；隐睾（P522）（B错）是指睾丸下降异常，使睾丸不能降至阴囊而停留在腹膜后、腹股沟管或阴囊入口处，多见于小儿，表现为患侧阴囊空虚，睾丸缺如，上述两种疾病的包块均不能还纳。股疝（P315）（C错）多见于40岁以上女性，包块位于腹股沟的下外方，可有咳嗽冲击感，疝块还纳后多不能完全消失。斜疝（P312）（D错）多见于儿童和青壮年，疝块经腹股沟管突出，可进入阴囊，咳嗽冲击试验阳性。